属于组胺H₂受体拮抗剂的是
A. 米索前列醇
B. 派仑西平
C. 法莫替丁
D. 兰索拉唑
E. 多潘立酮

正确答案：C。法莫替丁

解析：本题考查组胺H₂受体阻断剂。组胺H₂受体阻断剂法莫替丁（C对），可显著抑制胃酸分泌；前列腺素类似物米索前列醇（A错），具有增强黏膜抗损伤能力和加速溃疡愈合的作用；选择性抗胆碱能药物哌仑西平（B错）能抑制胃酸分泌，主要用于消化性溃疡、急性胃黏膜出血及胃泌素瘤；质子泵抑制剂兰索拉唑（D错）是抑制胃酸分泌和防治消化性溃疡的最有效药物；多潘立酮（E错）又名吗丁啉，为多巴胺D₂受体阻断剂。